下列哪项是分根术的适应证
A. 多根的上颌磨牙某一个或两个根的牙周组织破坏严重，且有Ⅲ度或Ⅳ度根分叉病变
B. 下颌磨牙根分叉区Ⅲ度或Ⅳ度病变，局部的深牙周袋不能消除
C. 牙周-牙髓联合病变，有一根明显受累
D. 下颌磨牙根分叉病变，其中一根受累另一侧较健康，不松动，并能进行根管治疗
E. 磨牙的一个根发生纵裂或横折，而其他根完好

正确答案：B。下颌磨牙根分叉区Ⅲ度或Ⅳ度病变，局部的深牙周袋不能消除

解析：分根术的适应证：①下颌磨牙根分叉区Ⅲ度或Ⅳ度病变，局部的深牙周袋不能消除者；②患牙两个根周围有充分的支持骨，牙无明显松动。掌握“根分叉病变”知识点。